极性最大的是
A. 乙醇
B. 石油醚
C. 苯
D. 氯仿
E. 乙酸乙酯

正确答案：A。乙醇

解析：本题考查的是常用溶剂的极性大小。极性最大的是乙醇（A对）。常用溶剂极性大小由弱到强依次为己烷＜苯（C错）＜乙醚（无水）＜三氯甲烷（D错）＜乙酸乙酯（E错）＜乙醇＜甲醇＜水。石油醚（B错）属于极性较小的溶剂。